以下符合生态学研究的特点的是
A. 属于分析流行病学
B. 以个体为观察分析单位
C. 群体水平上研究因素与疾病之间的关系
D. 确定病因
E. 以上均不是

正确答案：C。群体水平上研究因素与疾病之间的关系

解析：本题考查生态学研究的概念。生态学研究又称相关性研究，是描述性研究的一种类型，它是在群体的水平上研究某种暴露因素与疾病之间的关系（C对ABDE错），以群体为观察和分析的单位，通过描述不同人群中某因素的暴露状况与疾病的频率，分析该暴露因素与疾病之间的关系。